病例对照研究中病例与对照的选择
A. 病例较对照难选择
B. 对照较病例难选择
C. 病例与对照都容易选择
D. 病例与对照都不易选择
E. 新病例的对照不难选择

正确答案：B。对照较病例难选择

解析：本题考查病例对照研究对照的选择。在病例对照研究中，对照的选择往往比病例的选择更复杂、更困难（B对ACDE错）。对照必须是以与病例相同的诊断标准确认为不患所研究疾病的人。对照应该能够代表产生病例的源人群，即对照的暴露分布应该与病例源人群的暴露分布一致。